真性性早熟中无特殊原因查明者
A. 同性性早熟
B. 异性性早熟
C. 真性性早熟
D. 假性性早熟
E. 特发性性早熟

正确答案：E。特发性性早熟

解析：真性性早熟，是由于儿童 HPGA轴功能提前启动所致。下丘脑GnRH脉冲释放明显增强，垂体LH、FSH和卵巢、睾丸类固醇性激素浓度提前升高，配子开始形成，其发病机制复杂。其中原因不明者，称为特发性性早熟（E对C错）。假性性早熟又称外周性性早熟，非受控于HPGA轴，有第二性征的发育和性激素水平的升高，但是患儿的HPGA轴并未启动，反而受到体内存在的性激素的负反馈抑制，无性腺的发育，在临床上，性征与真实性别一致的称为同性性早熟，不一致者称为异性性早熟（ABD错）。